DIC时最常见的临床症状是：
A. 出血
B. 休克
C. MOF
D. 贫血
E. 以上都不对

正确答案：A。出血

解析：出血（A对BCDE错）是常为DIC患者最初的症状，也是最常见的临床症状。